男性外伤所致骨盆骨折易发生
A. 精囊损伤
B. 膀胱损伤
C. 尿道球部损伤
D. 输尿管损伤
E. 后尿道损伤

正确答案：E。后尿道损伤

解析：骨盆骨折易发生膀胱、后尿道（E对）与直肠损伤，但尿道的损伤远比膀胱损伤（B错）多见。